桂枝汤中桂枝与芍药的用量比例是
A. 1:2
B. 2:1
C. 1:1
D. 3:1
E. 4:1

正确答案：C。1:1

解析：桂枝汤桂枝三两，芍药三两，桂枝和芍药的用量比是1:1（C对）。麻黄杏仁甘草石膏汤麻黄四两，石膏半斤也就是八两，麻黄和石膏的比例是1：2（B错）麻黄杏仁甘草石膏汤麻黄四两，石膏半斤也就是八两，石膏和麻黄的比例是2：1（B错）。旋覆代赭汤中旋复花三两、代赭石一两，旋复花和代赭石用量比例为3:1（D错）。大黄牡丹汤大黄四两、牡丹皮一两，大黄和牡丹的用量比为4：1（E对）。